发展速度和增长速度都是
A. 构成比
B. 率
C. 变异度
D. 比
E. 频数

正确答案：D。比